可用于甲状腺抑制试验的是
A. 左甲状腺素
B. 胺碘酮
C. 放射性¹³¹I
D. 碘海醇
E. 丙硫氧嘧啶

正确答案：A。左甲状腺素

解析：本题考查左甲状腺素的应用。左甲状腺素（A对）可用于甲状腺抑制实验。